女性，16岁。因食过多桔子造成血中胡萝卜素增高，患者出现的皮肤黏膜黄染，首先常见于
A. 手掌、足底
B. 巩膜
C. 口腔黏膜
D. 躯干
E. 耳后

正确答案：A。手掌、足底

解析：本题考查皮肤黄染的原因。女性，16岁。因食过多桔子造成血中胡萝卜素增高，患者出现的皮肤黏膜黄染，首先常见于手掌、足底（A对DE错）。黄疸为血清内胆红素浓度增高使皮肤黏膜发黄，黄疸首先出现于巩膜（B错）、硬腭后部及软腭黏膜（C错）上，黏膜黄染更明显时，才会出现皮肤黄染。